女，43岁，右下腹持续性疼痛5天，伴恶心呕吐，呕出物为胃内容物。体温38.5℃。体检发现右下腹5cm×5cm大小肿块，触痛明显此时较合适的处理是
A. 急诊行阑尾切除术
B. 急诊手术脓肿引流
C. 肠道准备后行右半结肠切除术
D. X线钡灌肠
E. 暂不手术，保守治疗

正确答案：E。暂不手术，保守治疗

解析：青年女性患者，右下腹持续疼痛（提示病变位于右下腹），伴恶心、呕吐，体温38.5℃（正常为36～37℃），体检发现右下腹有一包块，触痛明显，结合患者病史和体查，应诊断为阑尾周围脓肿。对于病情稳定的阑尾周围脓肿，可暂不手术，行抗感染等保守治疗，待脓肿吸收消退后，择期手术切除阑尾，效果较急诊阑尾切除术好（E对A错）。手术脓肿引流（B错）适用于脓肿扩大，无局限趋势者。右半结肠切除术（C错）为右侧结肠癌的手术方式。X线钡灌肠（D错）对阑尾周围脓肿的诊断价值不大，亦无助于其治疗。